以下哪项不是急性牙周脓肿的治疗方法
A. 口服抗生素
B. 脓肿切开
C. 降低咬合
D. 漱口水含漱
E. 翻瓣刮治

正确答案：E。翻瓣刮治

解析：急性牙周脓肿的治疗：①急性牙周脓肿的治疗原则是消炎止痛、防止感染扩散以及使脓液引流。②在脓肿初期脓液尚未形成前，可清除大块牙石，冲洗牙周袋，将防腐抗菌药引入袋内，必要时全身给以抗生素或支持疗法。③当脓液形成且局限，出现波动时，可根据脓肿的部位及表面黏膜的厚薄，选择从牙周袋内或牙龈表面引流。前者可用尖探针从袋内壁刺入脓腔，后者可在表面麻醉下，用尖刀片切开脓肿达深部，以使脓液充分引流。切开后应彻底冲洗脓腔，然后敷防腐抗菌药物。过早的切开引流会造成创口流血过多和疼痛。切开引流后的数日内应嘱患者用盐水或氯已定等含漱。④对于患牙挺出而咬合接触疼痛者，可将明显的早接触点调磨，使患牙获得迅速恢复的机会。⑤慢性牙周脓肿可在洁治的基础上直接进行牙周手术。根据不同情况，作脓肿切除术，或翻瓣手术。掌握“牙周脓肿”知识点。